以下有关结核菌素试验的论述中，不恰当的是
A. 可判断机体有无抗结核免疫力
B. 局部红肿和硬结小于5mm，为阴性
C. 可检测机体细胞免疫功能
D. 12～18小时后观察结果
E. 原理是测定机体对结核菌的迟发型超敏反应

正确答案：D。12～18小时后观察结果

解析：结核菌素（OT）试验原理是测定机体对结核菌的迟发型超敏反应，以此判断机体有无抗结核免疫力。取OT（旧结核菌素）或PPD（结核菌纯蛋白衍生物）5单位（0.1ml），于前臂皮内注射，48～72小时后观察结果，局部红肿和硬结小于5mm，为阴性。掌握“结核、非结核分枝杆菌”知识点。